女性，12岁，鼻出血，躯干及四肢淤点淤斑，发病前2周有感冒史，脾不肿大，血小板20×109/L，出血时间12min凝血时间正常，骨髓象增生，巨核细胞增多，幼稚型巨核细胞0.40，产血小板型巨核细胞缺少，诊断为
A. 再生障碍型贫血
B. 特发性ITP
C. 急性白血病
D. 过敏性紫瘢
E. 继发性ITP

正确答案：B。特发性ITP

解析：特发性血小板减少性紫癜诊断要点：①至少2次化验血小板计数减少，血细胞形态无异常；②体检脾脏一般不增大；③骨髓巨核细胞增多或正常，伴有成熟障碍；④排除其他继发性血小板减少症。此患者的临床表现符合此诊断要点，所以可以诊断为特发性血小板减少性紫癜。掌握“特发性血小板减少性紫癜（ITP）”知识点。